冠状缝是哪些骨之间的连接
A. 顶骨和颞骨
B. 额骨和顶骨
C. 额骨和鼻骨
D. 顶骨和枕骨
E. 两额骨之间

正确答案：B。额骨和顶骨

解析：额骨与两侧顶骨连结构成冠状缝（B对）。两侧顶骨与枕骨连结成人字缝（D错）。